女孩，5岁。精神欠佳半个月，发热、头痛、呕吐10天。半个月前开始出现精神不佳，10天来每天发热，最高体温38.1℃，进食减少，伴头痛、呕吐。2个月前曾患“麻疹”。查体：精神差，消瘦，右眼外展受限，颈抵抗（+），Kernig征（+），Brudzinski征（+），PPD试验（-）。最可能的诊断是
A. 化脓性脑膜炎
B. 结核性脑膜炎
C. 隐球菌性脑膜炎
D. 病毒性脑炎
E. 流行性脑脊髓膜炎

正确答案：B。结核性脑膜炎

解析：5岁患儿，精神欠佳半个月，发热、头痛、呕吐10天（结核性脑膜炎早期表现）。半个月前开始出现精神不佳，10天来每天发热，最高体温38.1℃，进食减少，伴头痛、呕吐（脑膜刺激期）。2个月前曾患“麻疹”（近期急性传染病史）。查体：精神差，消瘦，右眼外展受限，颈抵抗（+），Kernig征（+），Brudzinski征（+）（脑膜刺激征阳性），PPD试验（-）（结核性脑膜炎50%的患儿可呈阴性反应）。根据患者的病史、临床表现、辅助检查，目前的诊断考虑为结核性脑膜炎（B对）。化脓性脑膜炎（A错）临床表现为急性发热、惊厥，而结核性脑膜炎呈亚急性起病，不规则发热1~2周后才出现脑膜刺激征、惊厥或意识障碍等表现；隐球菌性脑膜炎（C错）患者多有鸽粪接触史，临床表现有间歇性自然缓解；病毒性脑炎（D错）是指由多种病毒引起的颅内急性炎症，患儿呈急性起病，主要表现为发热、反复惊厥发作、不同程度的意识障碍和颅内压增高症状；流行性脑脊髓膜炎（E错）是由脑膜炎奈瑟菌引起的急性化脓性脑膜炎，主要的表现为突发高热、剧烈头痛等，常伴有皮肤黏膜淤点、淤斑，且患者多有流脑的流行病学史。